下列受脊神经支配的肌是
A. 肛门内括约肌
B. 咽喉肌
C. 眼轮匝肌
D. 尿道膜部括约肌
E. 幽门内括约肌

正确答案：D。尿道膜部括约肌

解析：脊神经可分为5部分，分别为颈神经8对，胸神经12对，腰神经5对，骶神经5对，尾神经1对。尿道膜部括约肌（D对）受骶丛发出的阴部神经支配。肛门内括约肌（A错）受内脏神经支配。咽喉肌（B错）受脑神经之一的迷走神经支配。眼轮匝肌（C错）受面神经支配。幽门内括约肌（E错）受副神经支配。